仅接触黏膜而不进入骨组织的器械为
A. 高危器械
B. 中危器械
C. 低危器械
D. 超高危器械
E. 超低危器械

正确答案：B。中危器械

解析：中危器械指仅接触完整的黏膜或破损的皮肤，而不进入无菌组织器官的口腔器械。掌握“口腔器械的消毒与灭菌及医疗废物处理”知识点。